盖髓术不适用于
A. 意外穿髓直径≤0．5mm的恒牙
B. 年轻恒牙的机械性露髓（直径≤0．5mm）
C. 去龋未尽露髓的成熟恒牙
D. 鉴别慢性牙髓炎的诊断性治疗
E. 急性深龋不能一次去尽软化牙本质时

正确答案：C。去龋未尽露髓的成熟恒牙

解析：本题考查盖髓术的适应证。盖髓术分为直接盖髓术和间接盖髓术。去龋未尽露髓的成熟恒牙（C错，为本题的正确答案），若进行直接盖髓，残留在牙髓内的细菌及毒性产物可能引起牙髓持续炎症，长期的慢性刺激会导致牙髓钙化或牙内吸收，导致治疗失败。意外穿髓的恒牙（直径≤0.5mm）（A对）或者机械性露髓的年轻恒牙（直径≤0.5mm）（B对）都可以用直接盖髓术进行治疗，以保存活髓。无明显自发痛，去净腐质未见穿髓却难以判断是慢性牙髓炎或可复性牙髓炎时，可采用间接盖髓术作为诊断性治疗（D对），若以后无任何症状，则是后者，否则要进行牙髓治疗。急性深龋一次去尽软化牙本质会有露髓的可能，为了避免露髓，可采用间接盖髓二次去腐法，即先保留少许近髓的软龋，覆盖氢氧化钙，10～12周后，软化牙本质会变为灰色干燥牙本质并且近髓侧会有修复性牙本质生成，此时，再将腐质去净（E对）。